肉鱼样品水浸液在弱碱下与水蒸气一起蒸馏出来的总氮量称为
A. 不可挥发性氮
B. 挥发性总氮
C. 挥发性盐基总氮
D. 挥发性食物氮
E. 挥发性水解氮

正确答案：C。挥发性盐基总氮

解析：本题考查挥发性盐基总氮。挥发性盐基总氮（C对ABDE错）指食品水浸液在碱性条件下能与水蒸气一起蒸馏出来的总氮量。